一牙周病患者，全口牙拔除两周后即做全口义齿修复，半年后义齿固位差，张口说话易脱落。最可能的原因是
A. 人工牙排列偏唇颊侧
B. 颌位关系错误
C. 垂直距离过高
D. 基托边缘过度伸展
E. 牙槽嵴吸收

正确答案：E。牙槽嵴吸收

解析：本题考查戴用义齿后可能出现的问题及原因。因牙周病导致牙齿缺失而行全口义齿修复的患者，其牙槽嵴吸收（E对）要其他患者速度快，该患者义齿修复半年后，出现义齿固位差的现象，多由于牙槽嵴吸收,义齿与牙槽嵴不密合而导致义齿固位力下降。人工牙排列偏唇颊侧（A错）会影响义齿的稳定，在发生咬合时会出现义齿以人工牙排列偏唇颊侧这一端为支点的翘动现象。颌位关系错误（B错）会在咀嚼食物时出现翘动等不稳定现象，与义齿的固位无关。垂直距离过高（C错），在说话和进食时可出现后牙相撞声，面部酸痛等现象，义齿容易脱落，但与牙周病无关。基托边缘过度伸展（D错）会影响义齿的固位，导致义齿容易脱落，但牙周病患者义齿修复后出现固位差，主要原因是牙槽嵴的吸收。